女，60岁。反复咳嗽咳痰25年，心悸气促下肢间歇水肿3年，病情加重伴畏寒发热1周入院。体检：T38度，呼吸急促，口唇发绀，双肺叩诊过清音，中下肺闻及湿啰音，心率110次/分，心律齐，无杂音，双下肢重度水肿。该病例最适当的诊断应为
A. 慢性支气管炎
B. 慢性阻塞性肺疾病（COPD）
C. COPD+肺心病
D. 支气管哮喘+肺气肿
E. 慢支+肺气肿+冠心病

正确答案：C。COPD+肺心病

解析：患者为老年女性，反复咳嗽、咳痰25年（为慢阻肺的标准性症状），双肺叩诊过清音，病情加重伴畏寒发热1周，考虑诊断为COPD急性加重期。现患者病情加重，呼吸急促，口唇发绀，双下肢重度水肿，提示有右心衰竭，考虑诊断为由COPD引起的慢性肺心病（C对）。慢性支气管炎（A错）主要表现为咳嗽、咳痰伴有喘息，症状较轻。支气管哮喘（D错）具有反复发作性，发作时可闻及双肺弥漫性哮鸣音，呼气音延长，症状可在数分钟内发生，持续数小时至数天，可经平喘药治疗或自行缓解，与本病例不符。冠心病（E错）以发作性胸痛为临床表现，部位在胸骨体之后可波及心前区，与本病例不符。